某药店经营者为贪图利益而销售超过有效期的药品，结果造成患者服用后死亡的特别严重后果，依据《中华人民共和国刑法》，给经营者的刑罚是
A. 处3年以下有期徒刑或拘役，并处罚金
B. 处3年以上7年以下有期徒刑，并处罚金
C. 处3年以上10年以下有期徒刑，并处罚金
D. 处10年以上20年以下有期徒刑，并处罚金
E. 处10年以上有期徒刑或无期徒刑，并处罚金

正确答案：E。处10年以上有期徒刑或无期徒刑，并处罚金

解析：超过有效期的药品属于劣药，药店经营者销售劣药，并且造成患者死亡的特别严重后果，依据《中华人民共和国刑法》，该经营者应处10年以上有期徒刑或者无期徒刑，并处销售金额50%以上2倍以下罚金或者没收财产（E对）。